增加患者出现高血糖或低血糖症隐患的药品是
A. 头孢哌酮
B. 拉氧头孢
C. 利巴韦林
D. 加替沙星
E. 尼美舒利

正确答案：D。加替沙星

解析：本题考查加替沙星的不良反应。加替沙星（D对）的不良反应之一是引起血糖异常。头孢哌酮（A错）可引起过敏反应，长期使用可引起不敏感细菌过度生长，但不会引起血糖紊乱。拉氧头孢（B错）的不良反应有偶可致过敏性休克或其它过敏症状。利巴韦林（C错）的不良反应有溶血性贫血，白细胞减少，皮疹、腹泻、胃肠道出血和血清胆红素升高等。尼美舒利（E错）为选择性COX-2抑制剂，不良反应为形成血栓。